中、晚期妊娠的体征错误的是
A. 子宫增大
B. 胎动
C. 见红
D. 胎儿心音
E. 胎头圆而硬，有浮球感

正确答案：C。见红

解析：中晚期妊娠的临床表现有：1.子宫（A对）。随着妊娠的发展，子宫逐渐增大，手测子宫底高度或尺测耻上子宫高度，可以判断子宫大小与妊娠周数是否相符；2.胎动（B对）。胎儿在子宫内冲击子宫壁的活动成为胎动，一般孕妇于妊娠18-20周时开始自觉有胎动，每小时约3-5次，妊娠周期越多，胎动越活跃，但至妊娠末期胎动逐渐减少；3.胎心音（D对）。妊娠18-20周，用听诊器即可在孕妇腹壁上听见胎心音，呈双音，第一音与第二音相接近，如钟表的滴答音；4.胎体（E对）。妊娠20周以后，经腹壁可以触及子宫内的胎体，妊娠24周以后，运用四步触诊法可以区分胎头，胎臀，胎背及胎儿四肢，从而判断胎产式、胎先露和胎方位。中晚期的妊娠的体征不包括见红（C错，为本题正确答案）。